临床医生在药物治疗中应遵循的道德要求是
A. 对症下药，剂量尽可能大
B. 尽量开价格较高、质量较好药物
C. 严守法规，接受监督
D. 为满足部分患者要求，可开大处方药
E. 合理配伍，以“多头堵”大包圈”为原则

正确答案：C。严守法规，接受监督